不发生垂直传播的病毒是
A. 风疹病毒
B. 巨细胞病毒
C. 乙型肝炎病毒
D. 人免疫缺陷病毒
E. 脊髓灰质炎病毒

正确答案：E。脊髓灰质炎病毒